结脉与促脉主要不同点，在于
A. 脉形的长短
B. 脉力的大小
C. 脉位的浮沉
D. 脉率的快慢
E. 脉律的齐否

正确答案：D。脉率的快慢

解析：结脉与促脉二者歇止均不规则，促脉是脉来急促，节律不齐；结脉是脉来迟缓，脉律不齐（D对）。脉形的长短是长脉与短脉的主要不同点（A错）。脉力的大小是实脉与虚脉的主要不同点（B错）。脉位的浮沉是浮脉与沉脉的主要不同点（C错）。脉律的齐否是促、结、代三种脉象的主要不同点（E错）。